患者久病，症见舌卷、舌强，语謇或失语，主要为哪项功能失常
A. 心主血脉
B. 心主神志
C. 肝主筋脉
D. 脾主肌肉
E. 肝主藏血

正确答案：D。脾主肌肉

解析：患者出现舌卷、舌强，语謇或失语都是肌肉失养，倦怠无力。全身的肌肉有赖于脾胃运化的水谷精微的营养滋润，才能壮实丰满，并发挥其运动功能。脾主肌肉的功能失调，脾失健运，水谷精微生成和转输障碍，则肌肉失养，软弱无力甚至痿软不用（D对）。心主血脉（A错）的功能失常则容易出现心悸、心慌、汗出等症状。心主神志（B错）的功能失常则容易出现心血不足，心神失常，心悸失眠等症状。肝主筋脉（C错）的功能失常则容易出现肝血不足，筋脉失养，运动能力减弱的临床表现。肝主藏血（E错）的功能失常则容易出现肢体麻木，经量不足，失眠多梦等临床表现。